毒性强度最小的局麻药物是
A. 普鲁卡因
B. 布比卡因
C. 利多卡因
D. 阿替卡因
E. 丁卡因

正确答案：A。普鲁卡因

解析：本题考查局麻药。毒性强度最小的局麻药物是普鲁卡因（A对）。以普鲁卡因效能强度1、毒性强度1为标准；布比卡因效能强度8，毒性强度4（B错）；利多卡因效能强度2，毒性强度2（C错）；阿替卡因效能强度1.9，毒性强度1～1.5（D错）；丁卡因10～20，毒性强度10～20（E错）。普鲁卡因不能穿透皮肤黏膜，组织内扩散力差，有扩血管作用，属于短效麻药，剂量过大或短时间静脉注入可引起毒性反应。